最易生风动血的邪气是
A. 湿邪
B. 火邪
C. 风邪
D. 寒邪
E. 暑邪

正确答案：B。火邪

解析：火热为阳邪，易伤津耗气、生风动血（B对），易扰心神，易致疮疡。湿为重浊之邪，属阴，其性重浊、黏滞，易伤阳气，易阻气机，易袭阴位（A错）。风为百病之长，主动，善行而数变，轻扬开泄、易袭阳位（C错）。寒邪性收引、凝滞，易伤阳气（D错）。暑性升散，易伤津耗气（E错）。